残髓炎的治疗原则是
A. 干尸疗法
B. 直接盖髓术
C. 活髓切断术
D. 再根管治疗
E. 拔出患牙

正确答案：D。再根管治疗

解析：残髓炎的治疗原则去除残髓或找到并处理遗漏根管，重做根管治疗。掌握“残髓炎及逆行性牙髓炎”知识点。